女，21岁。关节疼痛、口腔溃疡4个月，双手指遇冷变白、变紫2个月，发热、下肢水肿2周。实验室检查：血Hb89g/L，WBC2.3×10⁹/L，Plt80×10⁹/L；尿蛋白（++）；尿红细胞（++）。最可能的诊断是
A. 再生障碍性贫血
B. 肾结核
C. 系统性红斑狼疮
D. 急性肾小球炎
E. 类风湿性关节炎

正确答案：C。系统性红斑狼疮

解析：育龄患者女性（系统性红斑狼疮好发人群），出现发热、下肢水肿、关节疼痛、口腔溃疡（系统性红斑狼疮的典型表现），抗RNP抗体就会导致雷诺综合症，即双手变红、变紫，双手指遇冷变白、变紫（雷诺现象），尿常规提示血尿、蛋白尿（系统性红斑狼疮肾损害），根据该患者病史、体查和实验室检查，可考虑诊断为系统性红斑狼疮（C对）。再生障碍性贫血（A错）主要表现为贫血、出血、感染症状。肾结核（B错）患者有低热、盗汗等症状，肾脏一般不会受累。急性肾小球炎（D错）多见于儿童，起病急，典型者呈急性肾炎综合征表现，即血尿、蛋白尿、水肿、高血压及肾功能异常，无四肢关节肿痛及口腔溃疡。类风湿性关节炎（E错）关节肿痛多累及腕、掌指、近端指间关节等小关节，且很少累及肾（P808）。